垂体后叶储存的激素是
A. ADH
B. PRL
C. TRH
D. PTH
E. MT

正确答案：A。ADH

解析：ADH（抗利尿激素）（A对）在下丘脑合成后运输在神经垂体的末梢并储存机体需要时是释放入血。PRL（催乳素）（B错）主要由腺垂体分泌（P384）。TRH促甲状腺激素释放激素（C错）是由下丘脑促垂体区小细胞神经元分泌，能调节腺垂体活动的肽类物质（P380）。PTH（甲状旁腺素）（D错）由甲状旁腺分泌（P397）。MT（褪黑素）（E错）是松果体分泌的主要激素（P387）。